引起根尖周感染的最主要途径为
A. 深牙周袋
B. 楔状缺损
C. 磨损
D. 副根管
E. 深龋

正确答案：E。深龋

解析：本题考查引起根尖周感染的最主要途径。牙髓感染的常见原因是龋病，而根尖周的感染主要继发于牙髓感染，引起根尖周感染的最主要途径为深龋（E对）。深牙周袋（A对）、楔状缺损（B错）、磨损（C错）、副根管（D错）等也可引起根尖周感染，但发生率低于深龋引起根尖周炎的机率。